按一级动力学消除的药物有如下特点
A. 药物的半衰期随剂量而改变
B. 并非为大多数药物的消除方式
C. 单位时间内实际消除的药量递减
D. 酶学中的Michaclis-Mcnton公式与动力学公式相似
E. 以固定的间隔给药，体内血药浓度难以达到稳态

正确答案：C。单位时间内实际消除的药量递减

解析：一级消除动力学是体内药物按恒定比例消除（D错），在单位时间内的消除量与血浆药物浓度成正比（C对），大多数药物在体内按一级动力学消除（B错），其特点有：①恒比消除即单位时间内体内药物按恒定比例消除，血中药物消除速率与血中药物浓度成正比；②半衰期恒定（A错），为一个常数；③相同剂量相同间隔时间给药途径经5个半衰期达稳态浓度，按一级动力学消除的药物经过第一个半衰期可消除50%，经过两个半衰期消除75%，经过5个半衰期体内药物清除约97%，也就是说约经5个半衰期药物可从体内基本消除。根据半衰期可确定给药间隔时间，通常给药间隔时间约为一个半衰期（E错），这样既可以避免给药过频，又可以在两次给药间隔内保持较高的血药浓度。